属于胸固有肌的是
A. 肋间内肌
B. 胸小肌
C. 前锯肌
D. 冈下肌
E. 无

正确答案：A。肋间内肌

解析：属于胸固有肌的是肋间内肌（A对）、肋间外肌、肋间最内肌、胸横肌。